汞量法测定青霉素钠含量时，以电位法指示终点，在滴定曲线上出现两个指示点，青霉素含量的计算系以第二次滴定终点为依据，此时青霉素与汞的摩尔比为
A. 1:0.5
B. 1:1
C. 1:2
D. 1:3
E. 1:4

正确答案：B。1:1